引起波浪热的主要原因是
A. 反复形成败血症
B. 细菌容易变异
C. 细菌有较特殊的内毒素
D. 细菌在胞内繁殖，抗体和药物难起直接作用
E. 反复形成菌血症，细菌内毒素刺激体温调节中枢

正确答案：E。反复形成菌血症，细菌内毒素刺激体温调节中枢

解析：人类主要通过为病畜接生羊羔或牛犊等接触病畜及其分泌物，或接触被污染的畜产品，病菌经皮肤、黏膜、眼结膜、消化道、呼吸道等不同途径感染布鲁氏菌。由于内毒素作用，导致患者发热，随后细菌进入肝、脾、骨髓、淋巴结等网状内皮系统形成新的感染灶，再次进入血液，又出现菌血症而致体温升高。如此反复形成菌血症，使患者的热型呈波浪式，临床上称为波浪热，并容易变为慢性疾病及反复发作。掌握“动物源性细菌”知识点。